可与阿司匹林制成复方制剂或联合使用作为脑卒中二级预防的药物是
A. 尿激酶
B. 那屈肝素钙
C. 华法林
D. 阿加曲班
E. 双嘧达莫

正确答案：E。双嘧达莫

解析：本题考查药物的作用。双嘧达莫（E对）属于磷酸二脂酶抑制剂，可抑制磷酸二酯酶对cAMP的降解作用，使血小板内cAMP浓度增高而产生抗血小板作用；与小剂量阿司匹林联合应用，用于脑卒中的二级预防。尿激酶（A错）为溶栓药，临床用于血栓栓塞性疾病的溶栓治疗。那屈肝素钙（B错）为低分子肝素，具有快速、持续的抗血栓作用。华法林（C错）为维生素K拮抗剂类抗凝血药。阿加曲班（D错）是一种新型凝血酶抑制剂，可用于缺血性脑梗死急性期病人的抗凝治疗。